艾叶除温经止血外，又能
A. 清热安胎
B. 解毒止痢
C. 散寒止痛
D. 疏肝止痛
E. 清肝泻火

正确答案：C。散寒止痛

解析：本题考查的是艾叶的功效。艾叶除温经止血外，又能散寒止痛（C对）。艾叶：【功效】温经止血，散寒止痛。苎麻根：【功效】凉血止血，清热安胎（A错），利尿，解毒。白头翁：【功效】清热解毒，凉血止痢（B错）。香附：【功效】疏肝理气，调经止痛（D错）。槐花：【功效】凉血止血，清肝泻火（E错）。